支气管哮喘急性发作时，宜使用的药物是
A. 沙美特罗氟替卡松粉吸入剂
B. 吸入用布地奈德混悬液
C. 孟鲁司特钠咀嚼片
D. 沙丁胺醇气雾剂
E. 噻托溴铵干粉吸入剂

正确答案：D。沙丁胺醇气雾剂

解析：本题考查支气管哮喘急性发作常用药物。支气管哮喘急性发作时，宜使用的药物是沙丁胺醇气雾剂（D对）。哮喘急性发作首选药为短效β₂受体激动剂沙丁胺醇、特布他林，平喘作用维持时间4～6h，吸入给药。丙酸倍氯米松、丙酸氟替卡松（A错）、布地奈德（B错），是当前控制气道炎症、控制哮喘症状、预防哮喘发作的最有效药物，是哮喘长期控制的首选药，而不是哮喘急性发作首选药。孟鲁司特（C错）、扎鲁司特，适用于阿司匹林哮喘、运动性哮喘、无法应用或不愿使用吸入性糖皮质激素的哮喘患者，以及同时伴有过敏性鼻炎的哮喘患者，口服给药。异丙托溴铵、噻托溴铵（E错），起效慢，长期应用不易产生耐药性，适用于有吸烟史的老年哮喘患者，气雾剂或干粉吸入给药。